头颅骨发育，骨缝出生时稍分离或重叠，一般于生后多久时闭合
A. 2～3个月
B. 3～4个月
C. 4～8个月
D. 8～12个月
E. 1～1岁半

正确答案：B。3～4个月

解析：骨缝出生时稍分离或重叠，一般于生后3～4个月时闭合。掌握“骨骼发育”知识点。